统发定点零售药店标牌，负责向社会公布定点零售药店的是
A. 劳动保障行政部门
B. 药品监督管理部门
C. 卫生行政部门
D. 社会保险经办机构
E. 工商行政管理部门

正确答案：D。社会保险经办机构